引起白蛋白/球蛋白A/G降低的疾病是
A. 肾上腺皮质功能减退症
B. 急性肝炎
C. 阻塞性黄疸
D. 甲状腺功能亢进症
E. 慢性肝炎

正确答案：E。慢性肝炎

解析：低蛋白血症主要机制有：①合成障碍：慢性肝炎、肝硬化、肝癌等慢性肝脏疾病。②摄入不够：营养不良、胃肠道肿瘤、胃肠部分切除等。③丢失或消耗过多：肾病综合征、大面积烧伤、急性大失血，慢性消耗性疾病如甲亢、重症肺结核、恶性肿瘤等（E对）。肾上腺皮质功能减退症可有低血钠、高血钾。脱水严重者低血钠可不明显高血钾一般不严重，如甚明显需考虑肾功能不良或其他原因，少数患者可有轻度或中度高血钙（糖皮质激素有促进肾、肠排钙作用），如有低血钙和低血磷则提示合并有甲状旁腺功能减退症。常有正细胞性、正色性贫血，少数患者合并有恶性贫血。白细胞分类示中性粒细胞减少，淋巴细胞相对增多，嗜酸性粒细胞明显增多（A错）。急性肝炎是一类疾病的统称，虽然病因不同，但其临床特点、治疗方法以及预后结局有很多共同的特征：⑴肝功能呈现明显的急性损伤，ALT升高10倍以上即>400U/L，通常可达到1000-2000u/l，可伴有黄疸出现；⑵肝组织均有不同程度的坏死，无纤维结缔组织增生，⑶病情发展多可顺利恢复。⑷急性期均需要休息并积极保肝治疗（B错）。阻塞性黄疸由于胆汁不能进入肠道而粪色变淡或呈陶土色，尿胆原减少或缺如。胆道阻塞后，肠道内缺乏胆汁酸、 胆固醇 等，加以脂溶性维生素的缺乏，临床上可表现为脂肪泻、皮肤黄色疣、出血倾向、骨质疏松等；癌性阻塞者尚可出现Courviosier征（C错）。甲亢患者甲状腺分泌的T₃、T₄、FT₃、FT₄明显升高，由于甲状腺和垂体轴的反馈作用，TSH常常降低。如果一个患者的T₃、T₄、FT₃、FT₄升高，同时伴TSH下降，即甲状腺功能亢进。由于甲亢多数是Graves病，是甲状腺自身免疫病，所以常常伴随甲状腺自身抗体升高，甲状腺球蛋白抗体和甲状腺过氧化物酶抗体升高，Graves病患者是由于滤胞细胞产生了一种刺激甲状腺功能的免疫球蛋白-TSI，所以临床检验促甲状腺素（TSH）受体抗体-TRAb阳性（D错）。